一胎儿性腺为卵巢。内生殖器属女性，外生殖器男性化，多毛。肌肉发达，染色体核型为46XX。这个胎儿可能存在哪种性分化异常
A. 真两性畸形
B. 男性假两性畸形
C. 性腺发育不全
D. 女性假两性畸形
E. 性发育延迟

正确答案：D。女性假两性畸形